与高血压发生有关的因素不包括哪项
A. 高钠盐饮食
B. 肥胖
C. 吸烟、饮酒
D. 长期的紧张、缺少锻炼
E. 饮食过多

正确答案：E。饮食过多